嘧啶从头合成途径首先合成的核苷酸为
A. UDP
B. CDP
C. TMP
D. UMP
E. CMP

正确答案：D。UMP